下列属于访谈法缺点的是
A. 提问较灵活
B. 同时了解到调查问卷以外的资料
C. 调查范围在地理上不能分布太分散
D. 访谈法的问卷回收率高
E. 随时对问题作出解释以避免误解

正确答案：C。调查范围在地理上不能分布太分散

解析：本题考查访谈法的缺点。访谈法是通过有目的谈话来收集资料的过程。其缺点是涉及交通，且需要相当的人力物力，调查范围在地理上不能分布太分散（C对）。提问较灵活（A错），同时了解到调查问卷以外的资料（B错），访谈法的问卷回收率高（D错），随时对问题作出解释以避免误解（E错）均属于访谈法的优点。